主动脉的第一个分支是
A. 头臂干
B. 左颈总动脉
C. 左锁骨下动脉
D. 冠状动脉
E. 支气管动脉

正确答案：D。冠状动脉

解析：冠状动脉（D对）为主动脉的第一个分支，包括左、右冠状动脉。